散瞳和调节睫状肌麻痹宜选用
A. 左氧氟沙星滴眼液
B. 复方托吡卡胺滴眼液
C. 毛果芸香碱滴眼液
D. 碘苷滴眼液
E. 阿昔洛韦滴眼液

正确答案：B。复方托吡卡胺滴眼液

解析：本题考查复方托吡卡胺。复方托吡卡胺（B对）是散瞳药，属于抗M胆碱类，可以散大瞳孔，调节睫状肌麻痹。左氧氟沙星（A错）属于抗菌药。毛果芸香碱（C错）是拟M胆碱药，具有缩小瞳孔和降低眼压的作用。碘苷（D错）主要用于单纯疱疹性角膜炎及其它疱疹性眼病，阿昔洛韦（E错）主要用于单纯疱疹性角膜炎。